与2，6-二氯靛酚反应使颜色消失
A. 维生素B₁（盐酸硫胺）
B. 维生素C
C. 维生素K
D. 以上均不能

正确答案：B。维生素C

解析：本题考查常用的药品鉴别方法。与2，6-二氯靛酚反应使颜色消失的是维生素C（B对）。维生素C结构中含有连二烯醇，具有较强的还原性，可使二氯靛酚钠试液还原而褪色。维生素B₁在碱性条件下与铁氰化钾反应生成具有蓝色荧光的硫色素，不能使二氯靛酚钠试液褪色（ACD错）。